既凉血止血，又祛痰止咳的药是
A. 大蓟
B. 白及
C. 地榆
D. 侧柏叶
E. 棕榈炭

正确答案：D。侧柏叶

解析：本题考查的是侧柏叶的功效。既凉血止血，又祛痰止咳的药是侧柏叶（D对）。侧柏叶：【功效】凉血止血，祛痰止咳，生发乌发。大蓟（A错）：【功效】凉血止血，散瘀消痈。白及（B错）：【功效】收敛止血，消肿生肌。地榆（C错）：【功效】凉血止血，解毒敛疮。棕榈炭（E错）：【功效】收敛止血。